关于肘关节关节囊描述正确的是
A. 两侧薄弱，前、后有韧带加强
B. 内侧壁有尺侧副韧带加强
C. 内面有关节盘附着
D. 有囊内韧带
E. 以上都不对

正确答案：B。内侧壁有尺侧副韧带加强

解析：肘关节关节囊前后壁薄弱，两侧壁有韧带加强（A错），肘关节尺侧，即内侧壁有尺侧副韧带加强（B对）。人体中有关节盘的关节有：颞下颌关节、胸锁关节、桡尺远侧关节、桡腕关节等，肘关节内并无关节盘（C错）。人体内具有囊内韧带的关节有膝关节和髋关节，肘关节内并无（D错）。